过敏性紫癜（肾型）的肾损害多发生于紫癜出现后的
A. 1周
B. 1～2周
C. 1～3周
D. 3～4周
E. 4周以上

正确答案：A。1周

解析：过敏性紫癜（肾型），肾损害多发生于紫癜出现后1周。掌握“过敏性紫癜”知识点。